既主疼痛又主痰饮病的脉象是
A. 紧脉
B. 滑脉
C. 动脉
D. 牢脉
E. 弦脉

正确答案：E。弦脉

解析：弦脉多见于肝胆病、疼痛、痰饮等，或胃气衰败（E对）。紧脉多见于实寒证、疼痛、食积等（A错）。滑脉多见于痰湿、食积和实热等病证（B错）。动脉常见于惊恐、疼痛（C错）。牢脉多见于阴寒内盛、疝气、癥积等病证（D错）。